患者面色苍白，时而泛红如妆，其证型是
A. 实热内炽
B. 阴虚火旺
C. 肝胆湿热
D. 真寒假热
E. 真热假寒

正确答案：D。真寒假热

解析：在真寒假热证中，由于阳气虚衰，阴寒内盛，虚阳浮游于上、格越于外致使患者面色苍白，时而泛红如妆（D对）。实热内炽，阳热偏盛，故见面赤（A错）。阴虚火旺，阳热之气相对偏旺而生内热，故两颧潮红（B错）。肝胆湿热，湿热内阻，胆汁不循常道，泛溢肌肤，则身目发黄（C错）。真热假寒证由于邪热内盛，气血运行不畅，阳气郁闭于内而不能布达于外所致，故从表面上看会出现四肢厥冷、脉迟等症（E错）。